生产性粉尘按性质分类，哪种分类最全面
A. 无机粉尘、有机粉尘、混合性粉尘
B. 金属性粉尘、人工合成粉尘、有机粉尘
C. 矿物粉尘、人工合成粉尘、皮毛尘
D. 矿物粉尘、金属性粉尘、有机粉尘
E. 无机粉尘、有机粉尘、人工合成粉尘

正确答案：A。无机粉尘、有机粉尘、混合性粉尘

解析：本题考查生产性粉尘的分类。生产性粉尘按粉尘的性质可分为：（1）无机粉尘，包括矿物性粉尘、金属性粉尘、人工无机粉尘；（2）有机粉尘，包括动物性粉尘、植物性粉尘、人工有机粉尘；（3）混合性粉尘，在生产环境中，多数情况下为两种以上粉尘混合存在，如煤矿工人接触的煤矽尘、金属制品加工研磨时的金属和磨料粉尘、皮毛加工的皮毛和土壤粉尘等混合性粉尘（A对BCDE错）。